下列关于下颌姿势位与牙尖交错位的关系说法正确的是
A. 正常情况下，肌接触位是与牙尖交错位一致
B. 由下颌姿势位通过主动肌肉收缩上提下颌达到初始的（牙合）接触时，下颌的位置为肌接触位
C. 如果在闭合过程中遇到干扰，不能直接到达牙尖交错（牙合），则为肌位与牙位不调
D. 肌接触位就是肌位
E. 以上说法均正确

正确答案：E。以上说法均正确

解析：下颌姿势位与牙尖交错位的关系：由下颌姿势位通过主动肌肉收缩上提下颌达到初始的（牙合）接触时，下颌的位置为肌接触位（肌位）。正常情况下，肌接触位是与牙尖交错位一致。如果在闭合过程中遇到干扰，不能直接到达牙尖交错（牙合），则为肌位与牙位不调，（牙合）便是不稳定的。在从下颌姿势位向牙尖交错位的移动过程中，如果向上的距离小于1mm，或有向后、向前以及出现左右方向的移动，则表明存在某些异常因素，以咬合异常和肌功能异常最为多见。掌握“下颌姿势位、三类颌位与前伸、侧方（牙合）颌位”知识点。